银汞合金充填应进行磨光，因为
A. 可使修复体表面平滑
B. 可减少腐蚀
C. 增加修复物坚实度
D. 可减少局部电流的产生
E. 以上都是

正确答案：E。以上都是

解析：本题考查银汞合金应用的注意事项。打磨抛光可以去除修复体表面不平整的缺陷，可使修复体表面变得光滑（A对），不易附着菌斑，从而可减少腐蚀（B对）。同时反复磨光将修复体内多余的汞挤压出，增加修复体坚实度（C对）。银汞合金本身含有银、锡、铜、锌异种金属，在表面不光滑的情况下这些异种金属可以产生局部电流，磨光充填后的银汞合金表面，使表面变光滑可减少局部电流的产生（D对）。（ABCD均对，故E为本题的正确答案）。